女，22岁，在读大学生。于半年前觉得其身材不够苗条，开始极端地限制饮食，每餐只吃蔬菜、水果及极少量米饭。喝水较少，称水喝多了会浮肿。体型日渐消瘦，但其仍认为偏胖。近1个月暴饮暴食，进食后为避免体重反弹而自行催吐，每周4～5次，并出现失眠，整夜难以入睡，悄绪低落，不能坚持上课。该患者最可能的诊断是
A. 非器质性失眠症
B. 抑郁症伴贪食
C. 神经性呕吐
D. 神经性厌食症
E. 神经性贪食症

正确答案：E。神经性贪食症

解析：成年女性患者，病程3个月以上，有意造成体重下降，体型日渐消瘦，但其仍认为偏胖，有间歇发作的暴饮暴食，综合患者的症状、体征，该患者最可能的诊断是神经性贪食症，神经性贪食症是指具有反复发作的不可抗拒的摄食欲望，及多食或暴食行为，进食后又因担心发胖而采用各种方法减轻体重的一种进食障碍（E对）。非器质性失眠症（A错）患者没有对体重增加的过分恐惧。抑郁症伴贪食（B错）患者没有对体重增加的过分恐惧，同时具有情感低落、思维迟缓、意志活动减退、自我评价过低、悲观、自责、睡眠障碍等特点。神经性呕吐（C错）无怕胖的心理和减轻体重的愿望。神经性厌食 （D错）是指有意节制饮食，导致体重明显低于正常标准的一种进食障碍。